关于病因推断的论述，正确的是
A. 基于单一研究通常即可做出可靠的推论
B. 基于几项结果一致的同类研究通常即可做出可靠的推论
C. 无需考虑来自动物实验的证据
D. 对定性结论的推论，是为了判断某个因素是否为某种疾病的病因
E. 对定量结果的推论，是为了判断某个因素是否为多种疾病的病因

正确答案：D。对定性结论的推论，是为了判断某个因素是否为某种疾病的病因

解析：本题考查病因推断的相关内容。病因推断包括两个方面，分别是对定性结论的推论和对定量结果的推论。对定性结论的推论，是为了判断某个因素是否为某种疾病的病因（D对ABC错）。对定量结果的推论，是为了判断病因和疾病关系的强弱（E错）。